治疗吐衄便血，肝火上炎之头痛目赤，应选用的药物是
A. 侧柏叶
B. 地榆
C. 大蓟
D. 槐花
E. 小蓟

正确答案：D。槐花

解析：槐花的功效为凉血止血，清肝泻火。治疗血热便血，痔血，血痢，崩漏，吐血，衄血；肝热目赤，头痛眩晕（D对）。侧柏叶的功效为凉血止血，化痰止咳，生发乌发。治疗吐血，衄血，咳血，便血，崩漏下血；肺热咳嗽，咯痰黄稠；血热脱发，须发早白（A错）。地榆的功效为凉血止血，解毒敛疮。治疗血热便血，痔血，血痢，崩漏；水火烫伤，痈肿疮毒，湿疹（B错）。大蓟的功效为凉血止血，散瘀解毒消痈。治疗血热吐血、衄血、尿血、血淋、便血、崩漏，外伤出血；痈肿疮毒（C错）。小蓟的功效为凉血止血，散瘀解毒消痈。治疗血热吐血、衄血、尿血、血淋、便血、崩漏，外伤出血；痈肿疮毒（E错）。